甾体激素避孕药的避孕机理不包括
A. 影响输卵管生理功能
B. 改变宫颈黏液的性状
C. 抑制排卵
D. 阻止精子与卵子的结合
E. 改变子宫内膜形态与功能

正确答案：D。阻止精子与卵子的结合

解析：甾体激素避孕药的避孕机理包括：①抑制排卵（C对）；②改变宫颈黏液的性状（B对）；③改变子宫内膜形态与功能（E对）；④改变输卵管生理功能（A对）。可见甾体激素避孕药的避孕机理不包括阻止精子与卵子的结合（D错，为本题正确答案）。